临床应用证明安全有效，对细菌耐药性影响较小，价格较低的克林莓素属于
A. 非限制级抗菌药物
B. 重点监测级抗菌药物
C. 特殊使用级抗菌药物
D. 限制级抗菌药物

正确答案：A。非限制级抗菌药物

解析：本题考查的是抗菌药物分级和分级标准。临床应用证明安全有效，对细菌耐药性影响较小，价格较低的克林莓素属于非限制级抗菌药物（A对）。抗菌药物分级和分级标准：抗菌药物临床应用应当遵循安全、有效、经济的原则。抗菌药物临床应用实行分级管理。根据安全性、疗效、细菌耐药性、价格等因素，将抗菌药物分为三级：非限制使用级、限制使用级与特殊使用级。具体划分标准如下。（1）非限制使用级：经长期临床应用证明安全、有效，对细菌耐药性影响较小，价格相对较低的抗菌药物。（2）限制使用级（D错）：经长期临床应用证明安全、有效，对细菌耐药性影响较大，或者价格相对较高的抗菌药物。（3）特殊使用级（C错）：主要包括以下几类：①具有明显或者严重不良反应，不宜随意使用的抗菌药物；②需要严格控制使用，避免细菌过快产生耐药的抗菌药物；③疗效、安全性方面的临床资料较少的抗菌药物；④价格昂贵的抗菌药物。